牙周组织上皮屏障，最重要的是
A. 口腔龈上皮
B. 沟内上皮
C. 结合上皮
D. 缩余釉上皮
E. 牙龈上皮

正确答案：C。结合上皮

解析：龈牙结合部的牙龈组织借结合上皮与牙齿表面连接，称为上皮附着，封闭软硬组织的交界处。结合上皮的更新约为5天，比牙龈表面上皮的更新约快1倍。表层的衰老细胞以较快的速率脱落到龈沟内，同时使附着于结合上皮的细菌也随之脱落，这是龈牙结合部的重要防御机制之一。结合上皮在抗菌防御中不仅具有上皮屏障的作用，而且结合上皮细胞本身能产生有效的抗菌物质，包括防御素和溶酶体酶。掌握“牙周疾病促进因素”知识点。